患者，男，70岁，因泌尿道慢性感染就诊，经检测属于革兰阴性菌感染。其治疗药品处方组分中包括：主药、微晶纤维素(空白丸核）、乳糖、枸橼酸、EudragitNE30D、EudragitL30D-55、滑石粉、PEG6000、十二烷基硫酸钠。该制剂的主药规格为0.2g，需要进行的特性检查项目是
A. 不溶性微粒
B. 崩解时限
C. 释放度
D. 含量均匀度
E. 溶出度

正确答案：C。释放度

解析：本题考查缓释胶囊的特性检查项目。需要进行的特性检查项目是释放度（C对）。缓释胶囊应符合缓释制剂的有关要求并应进行释放度检查。注射剂应进行不溶性微粒（A错）检查；崩解时限（B错）是片剂、胶囊和滴丸制剂的重要控制指标；含量均匀度系（D错）指小剂量或单剂量的固体制剂、半固体制剂和非均相液体制剂的每片(个）含量符合标示量的程度；溶出度（E错）是片剂质量控制的一个重要指标，对难溶性的药物一般都应作溶出度的检查。